关于输液的叙述，错误的是
A. 输液是指由静脉滴注输入体内的大剂量注射液
B. 除无菌外还必须无热原
C. 渗透压应为等渗或偏高渗
D. 为保证无菌，需添加抑菌剂
E. 澄明度应符合要求

正确答案：D。为保证无菌，需添加抑菌剂

解析：本题考查输液。输液中不得添加任何抑菌剂，并在贮存过程中质量稳定（D错，为本题正确答案）。输液是由静脉滴注输入体内的大剂量（1次给药在100ml以上）注射液（A对）。输液的质量要求与注射剂基本上是一致的。但由于输液的注射量大，直接注入血液循环，因而质量要求更严格。无菌、无热原（B对）或细菌内毒素、不溶性微粒等项目必须符合规定（E对），pH与血液相近；渗透压应为等渗或偏高渗（C对）；不得添加任何抑菌剂，并在贮存过程中质量稳定；使用安全，不引起血液一般检测或血液常规检测的任何变化，不引起变态反应，不损害肝、肾功能。